使用麻醉药品的单位须有
A. 麻醉药品专用卡
B. 麻醉药品购用印鉴卡
C. 麻醉药品专用章
D. 麻醉药品进口注册证
E. 麻醉药品进口许可证

正确答案：B。麻醉药品购用印鉴卡

解析：本题考查印鉴卡。使用麻醉药品的单位须有麻醉药品购用印鉴卡（B对）。医疗机构需要使用麻醉药品和第一类精神药品的，应当经所在地设区的市级卫生健康主管部门批准，取得《麻醉药品、第一类精神药品购用印鉴卡》（以下简称《印鉴卡》），医疗机构应当凭印鉴卡向本省、自治区、直辖市行政区域内的定点批发企业购买麻醉药品和第一类精神药品。